男，64岁。上腹饱胀不适4个月，皮肤进行性黄染3个月。查体：皮肤、巩膜明显黄染。右上腹肋缘下可触及囊性包块，无触痛。为明确是否可行手术根治切除病灶，首选的检查是
A. 上消化道X线钡剂造影
B. 腹部B超
C. PET-CT
D. 胃镜
E. 腹部CT

正确答案：E。腹部CT

解析：该患者男，64岁，有上腹饱胀不适、黄染，右上腹肋缘下可触及囊性包块，无触痛，（胰腺癌40岁以上好发，男性比女性多见；主要临床变现以上腹部疼痛、饱胀不适，黄疸，食欲降低和消瘦最为多见），综合患者的病史、临床症状、体查，该患者诊断考虑为胰腺癌。腹部增强CT（E对）对显示肿瘤与邻近血管的关系以及评估根治性手术切除的可行性具有重要意义，目前可作为胰腺肿瘤的首选影像学检查手段。